患者，女，41岁，BMI25，最新诊断为2型糖尿病，空腹血糖8.4mmol/L，餐后2小时血糖16mmol/L，血肌酐70㎛ol/L。该患者首选的降糖药物是
A. 阿卡波糖
B. 地特胰岛素
C. 那格列奈
D. 二甲双胍
E. 吡格列酮

正确答案：A。阿卡波糖

解析：本题考查阿卡波糖。材料中患者餐后2小时血糖16mmol/L，餐后血糖过高，可选用阿卡波糖（A对）。阿卡波糖属于α-葡萄糖苷酶抑制剂，可作为单纯餐后血糖高，而空腹和餐前血糖不高的首选。